男，38岁。腹痛，反酸9年。1周来症状加重，并出现夜间痛，进食能部分缓解。最佳的治疗方案是
A. 手术治疗
B. 胃黏膜保护剂+抗生素
C. 胃黏膜保护剂+铋剂
D. 质子泵抑制剂+抗生素+铋剂
E. 质子泵抑制剂

正确答案：D。质子泵抑制剂+抗生素+铋剂

解析：该患者诊断为十二指肠溃疡。十二指肠溃疡患者的Hp（幽门螺杆菌）感染率高达90％～100％，所以治疗十二指肠溃疡首选根除幽门螺杆菌治疗，常采用三联疗法（1种质子泵抑制剂+2种抗生素或1种铋剂+2种抗生素）或四联疗法（1种质子泵抑制剂+2种抗生素+1种铋剂）（D对）。患者无大出血、穿孔、梗阻等并发症，所以无需手术治疗（A错）。胃黏膜保护剂+抗生素（B错）、胃黏膜保护剂+铋剂（C错）、单纯用质子泵抑制剂（E错）都不是正规的消化性溃疡治疗方案。